葡萄球菌污染食物的产毒条件是
A. 食物存放的环境
B. 食物的种类及性质
C. 食物存放的温度
D. 食物受污染的程度
E. 以上都是

正确答案：E。以上都是